铸造金属全冠牙体预备时，（牙合）面间隙应预备出
A. 0.5mm
B. 0.5～1.0mm
C. 0.5～1.5mm
D. 1.5～2.0mm
E. 以上都不是

正确答案：E。以上都不是

解析：本题考查铸造金属全冠的（牙合）面预备。（牙合）面预备的目的是为金属全冠提供（牙合）面空间，铸造金属全冠牙体预备时，（牙合）面间隙应预备出0.8～1.5mm（E对），一定的厚度保证修复体的强度，过厚则没有必要，反而对牙体组织磨除多，违背了牙体修复的生物学原则。但不同时期的不同教材对（牙合）面预备的具体要求可能不同，此处以（《口腔修复学（第八版）》为准。